噬菌体一般在75℃时多长时间失活
A. 10分钟
B. 20分钟
C. 30分钟
D. 1小时
E. 12小时

正确答案：C。30分钟

解析：噬菌体的概念：噬菌体是侵袭微生物的病毒，只含有一种核酸DNA或RNA，可感染细菌、真菌、螺旋体和支原体等。噬菌体对理化因素的抵抗力比一般细菌的繁殖体强，一般经75℃30分钟以上，才失去活性，对紫外线敏感。掌握“噬菌体性状及分类”知识点。